目前诊断慢性镉中毒的肾脏损害早期改变的主要依据是
A. 尿β2-微球蛋白、视黄醇结合蛋白等低分子量蛋白排出增多
B. 尿肌酐
C. 尿中溶菌酶
D. 尿镉含量
E. 尿钙含量

正确答案：A。尿β2-微球蛋白、视黄醇结合蛋白等低分子量蛋白排出增多

解析：本题考查目前诊断慢性镉中毒的肾脏损害早期改变的主要依据。慢性镉中毒是人群长期暴露于受镉污染的环境，主要是水体与土壤镉污染和由此导致的稻米与鱼贝类食物镉含量增高，造成摄入者体内镉蓄积并超过一定阈值所引起的以肾脏和骨骼损伤为主要中毒表现的环境污染性疾病。目前诊断慢性镉中毒的肾脏损害早期改变的主要依据是尿β₂-微球蛋白、视黄醇结合蛋白等低分子量蛋白排出增多（A对BCDE错）。